封闭式问题收集资料的优点是
A. 容易发生笔误
B. 能收到详细生动的资料
C. 答案全面、精确
D. 能反应真实情况
E. 容易回答

正确答案：E。容易回答

解析：本题考查封闭式问题收集资料的优点。从调查实施的难易度看，封闭式问题容易回答（E对ABCD错），节省时间，文化程度较低的被调查者也能完成，回答者比较乐于接受这种方式，因而问卷的回收率较高。